栓剂的质量检查项目包括
A. 溶散时限
B. 软化点
C. 崩解时限
D. 相对密度
E. 融变时限

正确答案：E。融变时限

解析：本题考查的是栓剂的质量要求。栓剂的质量检查项目包括融变时限（E对）。融变时限，除另有规定外，脂肪性基质的栓剂应在30分钟内全部融化、软化或触压时无硬芯，水溶性基质的栓剂应在60分钟内全部溶解。重量差异应符合规定，凡规定检查含量均匀度的栓剂，可不进行重量差异检查。栓剂的微生物限度照《中国药典》规定的检查方法检查，应符合规定。溶散时限（A错）为丸剂的质量检测项目。软化点（B错）为膏药的质量检测项目。崩解时限（C错）为胶囊剂、蜡丸与片剂的质量检测项目。相对密度（D错）为合剂与煎膏剂的质量检测项目。